属于蒽醌类抗生素的抗肿瘤药物是
A. 多柔比星
B. 拓扑替康
C. 甲氨蝶呤
D. 雷帕霉素
E. 奥沙利铂

正确答案：A。多柔比星

解析：本题考查抗肿瘤药。属于蒽醌类抗生素的抗肿瘤药物是多柔比星（A对）。蒽醌类抗生素抗肿瘤药有多柔比星、米托蒽醌、表柔比星等。拓扑替康（B错）属喜树碱类抗肿瘤药。甲氨蝶呤（C错）属抗代谢的抗肿瘤药。雷帕霉素（D错）是一种新型的大环内酯类免疫抑制剂。奥沙利铂（E错）为铂类化合物。